属于大气中二次污染物的是
A. 酸雨
B. S0₂
C. CO
D. NO
E. 苯并（a）芘

正确答案：A。酸雨

解析：二次污染物是指某些一次污染物进入环境后在物理、化学或生物学作用下，或与其他物质发生反应而形成与初始污染物的理化性质和毒性完全不同的新的污染物。因此属于大气中二次污染物的是酸雨（A对）。